供无破损皮肤揉擦用的剂型是
A. 涂剂
B. 搽剂
C. 乳膏剂
D. 凝胶剂
E. 糊剂

正确答案：B。搽剂

解析：本题考查的是搽剂。供无破损皮肤揉擦用的剂型是搽剂（B对）。搽剂系指原料药物用乙醇、油或适宜的溶剂制成的液体制剂，供无破损皮肤揉擦用。涂剂（A错）系指含原料药物的水性或油性溶液、乳状液、混悬液，供临用前用消毒纱布或棉球等柔软物料蘸取涂于皮肤或口腔与喉部黏膜的液体制剂。也可为临用前用无菌溶剂制成溶液的无菌冻干制剂，供创伤面涂抹治疗用。乳膏剂（C错）：系指原料药物溶解或分散于乳状液型基质中形成的均匀半固体制剂。凝胶剂（D错）系指原料药物与能形成凝胶的辅料制成的具凝胶特性的稠厚液体或半固体制剂。糊剂（E错）系指大量的原料药物固体粉末（一般25%以上）均匀地分散在适宜的基质中所组成的半固体外用制剂。可分水溶性糊剂和脂溶性糊剂。